以下哪项不属于口腔健康教育的目的
A. 鼓励人们建立正确的口腔健康意识
B. 提高自我口腔保健能力
C. 主动采取有利于口腔健康的行为
D. 树立终生维护口腔健康意识
E. 制定危险因素预防政策

正确答案：E。制定危险因素预防政策

解析：口腔健康教育的目的是通过口腔保健知识和技术的传播，鼓励人们建立正确的口腔健康意识，提高自我保健能力，主动采取有利于口腔健康的行为，终生维护口腔健康。掌握“口腔健康教育”知识点。